与病邪“从化”最为密切的因素是
A. 病变部位
B. 体质差异
C. 治疗不当
D. 病邪性质
E. 邪正盛衰

正确答案：B。体质差异

解析：“从化”实际是指病邪的性质依从病人体质而发生的变化，是很多疾病出现始同终异或始异终同，或在病的过程总出现相同证候的原因所在，是引起同病异证的一个重要原因。发生“从化”的原因外邪有风、寒、暑、湿、燥、火（热）的不同，人的体质也有阴阳、虚实、寒热之差，阳虚外寒，阴虚内热，阳盛则热，阴盛则寒，这不但是病理现象的反应，在正常的生理范围有时也会显现出来，如冬天有人穿的很多，有人穿的很少，夏天有的人怕热，又有人就不怕热，这都不是病理现象，但已经说明人的体质是有差异的。由于人的体质不同，因此，当外邪侵入，矛盾激化后，体质起的作用就最容易显现出来。很多疾病的发展变化中，是由人的体质来支配的，为病邪“从化”最为密切的因素，其他因素处于次要地位（B对）（ACDE错）。